牙周手术时，如果颊、舌侧龈组织高度相等，张力一致，缝针可同时穿过两侧龈瓣时，采用的方法是
A. 牙间间断缝合
B. 牙间“8”字形缝合
C. 悬吊缝合
D. 水平褥式缝合
E. 锚式缝合

正确答案：A。牙间间断缝合

解析：本题考查牙间间断缝合。牙周手术时，如果颊、舌侧龈组织高度相等，张力一致，缝针可同时穿过两侧龈瓣时，采用的方法是牙间间断缝合（A对）。牙间间断缝合有环形直接间断缝合和8字形间断缝合（B错）。悬吊缝合是利用牙齿来悬吊固定龈瓣，而不是将颊舌侧龈瓣简单地拉拢缝合，尤其适用于颊、舌两侧龈瓣高度不一致时，使每侧龈瓣分别在所复位的水平紧密的贴合于牙与骨面，不易发生松脱或过大张力（C错）。锚式缝合是最后一个磨牙远中的龈瓣或缺牙隙处的龈瓣以锚样的方式固定在邻近的牙上，适用于最后一个磨牙远中楔形瓣的缝合，或与缺牙间隙相邻处的龈瓣闭合（E错）。水平褥式缝合适用于两牙之间有较大缝隙或龈乳头较宽时，为使龈瓣更好的贴合于骨面（D错）。